治实寒证应采取的方法是
A. 寒因寒用
B. 以寒治寒
C. 用寒远寒
D. 以寒治热
E. 寒者热之

正确答案：E。寒者热之

解析：本题考查的是损其有余的含义和临床应用。治实寒证应采取的方法是寒者热之（E对）。对于阴阳偏盛，即阴邪或阳邪过盛有余的病证，应采用“损其有余”“实则泻之”之法。如阳热亢盛的实热证，应采用“热者寒之”之法，以清泻其阳热；阴寒内盛的实寒证，应采用“寒者热之”之法，以温散其阴寒。寒因寒用（A错），又称“以寒治寒（B错）”，属于反治，是指针对假寒的临床表现，用寒性药物进行治疗。适用于里热盛极、阳盛格阴，反见假寒之象的真热假寒证。用寒远寒（C错）属于因时制宜的原则。用寒远寒：冬季，气候由凉变寒，阴盛阳衰，阳气内敛，应避免过用寒性药物，以防伤阳。治热以寒（D错），即“热者寒之”。阳盛则热属实热证，宜用寒凉药以制其阳，治热以寒。